女，停经45天，出现晨起恶心、呕吐，到妇幼保健院检查，诊断为早孕。医生经过询问及检查，了解到以下基本情况，请筛查属于高危因素的是
A. 年龄30岁
B. 自然流产1次
C. BMI=18
D. 身高150cm
E. 有过阑尾炎手术史

正确答案：C。BMI=18

解析：本题考查孕早期筛查的高危因素。该女，停经45天，出现晨起恶心、呕吐，到妇幼保健院检查，诊断为早孕，需要筛查的高危因素是BMI=18（C对ABDE错），因BMI＜18.5属于偏瘦，孕妇体重偏轻会影响胎儿的正常发育，母体不能提供足够的营养物质，胎儿的发育会随着营养的供给不够而出现减缓或者是停滞的状态，会增加胎儿早产的可能性甚至增加胎儿的死亡率。